莱菔子配紫苏子、芥子，除能温肺化痰、消食除胀通便外，又能
A. 宣肺利咽止咳
B. 泻肺平喘利水
C. 利气宽胸止咳
D. 降气止咳平喘
E. 温肾纳气定喘

正确答案：D。降气止咳平喘

解析：本题考查莱菔子的配伍。莱菔子配紫苏子、芥子，除能温肺化痰、消食除胀通便外，又能降气止咳平喘（D对）。莱菔子【配伍】莱菔子配紫苏子、芥子：莱菔子性平，功能消食除胀、降气化痰；紫苏子性温，功能止咳平喘、降气消痰、润肠通便；芥子性温，功能温肺化痰、利气散结。三药相配，既温肺化痰，又降气止咳平喘，且消食除胀通便，治寒痰喘咳有效，兼食积便秘者尤佳。牛蒡子【功效】疏散风热，宣肺利咽（A错），解毒透疹，消肿疗疮。桑白皮【功效】泻肺平喘，利水消肿（B错）。瓜蒌【功效】清肺润燥化痰，利气宽胸（C错），消肿散结，润肠通便。沉香【功效】行气止痛，温中止呕，温肾纳气（E错）。